“实现的趋势”的理论归于
A. 精神分析
B. 行为治疗
C. 人本主义
D. 认知治疗
E. 人文主义

正确答案：C。人本主义

解析：本题考查“实现的趋势”的理论。“实现的趋势”的理论归于人本主义（C对）。精神分析（A错）是指在精神分析理论的指导下，治疗者运用向由联想、释梦、移情与反移情分析、阐释等技术，发现病人压抑在潜意识中的冲突，使病人领悟到心理问题的潜意识症结，让焦虑的情绪得到宣泄，从而使其能以现实的方式处理和适应各种情况。行为治疗（B错）是建立在行为学习理论基础上的心理治疗方法；是依据条件反射学说和社会学习理论，以减轻或改善来访者的症状或不良行为为目标的一类心理治疗技术总称。认知治疗（D错）主要目标是协助当事人克服认知的盲点、模糊的知觉、自我欺骗、不正确的判断，及改变其认知中对现实的直接扭曲或不合逻辑的思考方式；治疗者透过接纳、温暖、同理的态度，避免采用权威的治疗方式，引导当事人以尝试错误的态度，逐步进入问题解决的历程中。人文主义（E错）是一种哲学理论和一种世界观；人文主义以人，尤其是个人的兴趣、价值观和尊严作为出发点；对人文主义来说，人与人之间的容忍、无暴力和思想自由是人与人之间相处最重要的原则。